职业流行病学调查的目的主要是
A. 找出易感人群
B. 为制定职业卫生标准提供依据
C. 确定环境监测的范围
D. 找出接触职业有害因素与健康损害之间的联系
E. 确定职业有害因索的剂量-效应关系

正确答案：D。找出接触职业有害因素与健康损害之间的联系